冠状窦收集
A. 心的全部静脉血
B. 心的大部分静脉血
C. 心的小部分静脉血
D. 心室的静脉血
E. 心房的静脉血

正确答案：B。心的大部分静脉血

解析：心的大部分静脉血（B对）由冠状窦收集，亦有些小静脉可以直接注入心腔。